毒理学一般将动物实验按染毒期限逐级分为
A. 急性、亚急性、亚慢性、慢性
B. 亚急性、急性、慢性、亚慢性
C. 慢性、亚慢性、急性、亚急性
D. 急性、慢性、亚急性、亚慢性

正确答案：A。急性、亚急性、亚慢性、慢性

解析：本题考查毒理学对动物实验按染毒期限的分类。毒理学一般将动物实验按染毒期限逐级分为急性、亚急性、亚慢性、慢性（A对BCD错）。